“内风”产生的机理是
A. 体内气机之逆乱
B. 体内阳气之变动
C. 体内阴血之不足
D. 体内筋脉之失养
E. 体表络脉之失濡

正确答案：B。体内阳气之变动

解析：该题考查内风病机，主要有肝阳化风、热极生风、阴虚风动、血虚生风。“《临症指南医案》指出：内风乃身中阳气之变动”，风气内动，主要是体内阳气亢逆变动所致（B对）。体内气机之逆乱是肝阳化风的病因（A错）。体内阴血之不足、体内筋脉之失养、体表络脉之失濡是血虚生风的病因（CDE错）。